抗病毒药阿昔洛韦在静脉滴注时滴速必须缓慢，否则可能引起的不良反应是
A. 急性肝衰竭
B. 肺部纹理加重
C. 急性肾衰竭
D. 胰腺坏死
E. 心功能不全

正确答案：C。急性肾衰竭

解析：本题考查阿昔洛韦的典型不良反应。抗病毒药阿昔洛韦在静脉滴注时滴速必须缓慢，否则可能引起的不良反应是急性肾衰竭（C对）。阿昔洛韦不可以快速滴注，否则导致急性肾衰竭，滴注时间应控制在2h以上。